泪道不包括
A. 泪小管
B. 泪腺
C. 泪囊
D. 鼻泪管
E. 无

正确答案：B。泪腺

解析：泪道包括泪小管（A对）、泪囊（C对）和鼻泪管（D对），但不包括泪腺（B错，为本题正确答案）。